长期服用糖皮质激素，不产生下列哪种副作用
A. 肾上腺皮质萎缩
B. 高血糖
C. 溃疡或出血、穿孔
D. 满月脸
E. 白细胞减少

正确答案：E。白细胞减少

解析：本题考查糖皮质激素的副作用。长期服用糖皮质激素，不产生白细胞减少（E错，为本题正确答案）的副作用。糖皮质激素可负反馈抑制腺垂体分泌ACTH，引起肾上腺皮质萎缩（A对）；糖皮质激素可增高肝糖原，升高血糖（B对）；糖皮质激素可刺激胃酸或胃蛋白酶的分泌，降低胃肠黏膜对胃酸的抵抗力，诱发或加重胃、十二指肠溃疡，甚至发生消化道出血和穿孔（C对）；可引起医源性肾上腺皮质功能亢进症，又称库欣综合征，表现为肌无力与肌萎缩、皮肤变薄、向心性肥胖、满月脸（D对）、水牛背、痤疮、多毛、水肿、高血压、高脂血症、低钾血症、糖尿、骨质疏松等，停药后一般可自行恢复正常。